牙周袋深度的测量，要探测
A. 颊舌侧近中、中央、远中六个位点
B. 颊舌侧近中、远中四个位点
C. 颊侧近中、中央、远中、舌侧中央四个位点
D. 舌侧近中、中央、远中、颊侧中央四个位点
E. 颊舌侧中央二个位点

正确答案：A。颊舌侧近中、中央、远中六个位点

解析：本题考查牙周探诊的方法。牙周袋是病理性加深的龈沟，是牙周炎最重要的病理改变之一。通过牙周袋深度的测量可以判断牙周炎的严重程度。为了能反映牙周袋在牙面的位置、类型及深浅，使用牙周探针探查牙周袋时，要探查牙的颊舌侧近中、中央、远中六个位点6个位点（A对BCDE错）。且在探诊过程中应沿着牙周袋底提插式行走，以便探明同一牙面上不同深度的牙周袋。这6个位点位于牙齿的不同部位，能够较准确的反映患牙的牙周袋情况。